23岁，农民，在稻田劳作，因高热，全身肌肉酸痛7天，黄疸2天，于7月29日入院，查体：结膜充血，巩膜轻度黄疸，肝肋下1.0cm，脾不大，血象WBC8.3×10⁹/L，N72%，L28%，尿蛋白（+），总胆红素60umol/L。ALT350U/L，肥达反应“O”1:40。H：1：320。凝集溶解试验1：400，外斐氏反应O×1:80。根据以上资料考虑是以下哪种疾病
A. 伤寒
B. 斑疹伤寒
C. 钩端螺旋体病
D. 急性黄疸型肝炎
E. 流行性出血热

正确答案：C。钩端螺旋体病

解析：钩端螺旋体通过疫水传播，壮年男性农民多发，高热、肌肉酸痛黄疸并肝肿大、凝集溶解试验阳性符合钩端螺旋体病的黄疸出血型临床（C对）。